判断小儿体格发育最常用指标是
A. 动作发育能力
B. 语言发育程度
C. 智能发育水平
D. 神经反射发育
E. 体重、身高、头围

正确答案：E。体重、身高、头围

解析：体重、身高、头围（E对）、胸围、上臂围、皮下脂肪等常用做判断小儿体格发育的指标。动作发育能力（A错），语言发育程度（B错），智能发育水平（C错），神经反射发育（D错）在较大程度上受到家庭教育和环境的影响，对小儿的发育有一定的参考价值，但最常用的还是体重、身高、头围（E对）。